男性，40岁，有早期肝硬化史，胆囊炎，因劳累，近1周发热，39℃右季肋区不适，腹胀，下肢水肿，巩膜、皮肤深度黄染，腹腔积液征（+），凝血酶原时间延长，应诊断为
A. 肝硬化失代偿
B. 肝硬化自发腹膜炎
C. 慢性重型肝炎
D. 淤胆型肝炎
E. 亚急性重型肝炎

正确答案：C。慢性重型肝炎

解析：急性重型肝炎：既往无同型肝炎病史，起病甚急，可有发热、食欲缺乏、恶心、频繁呕吐、极度乏力等明显的消化道及全身中毒症状；黄疸逐渐加深；肝脏进行性缩小；有出血倾向、中毒性鼓肠、肝臭、少量腹水、急性肾衰竭（肝肾综合征）；起病14日以内出现不同程度的肝性脑病（Ⅱ～Ⅴ度）表现；凝血酶原活动度低于40%。慢性重型肝炎：慢性重型的临床表现与亚急性重型相似，是在慢性肝炎（肝硬化或携带者）基础上发生的亚急性重型肝炎。掌握“病毒性肝炎”知识点。